下列哪种间隙感染为最常见口腔颌面部间隙感染之一
A. 咬肌间隙感染
B. 舌下间隙感染
C. 咽旁间隙感染
D. 颞下间隙感染
E. 翼下颌间隙感染

正确答案：A。咬肌间隙感染

解析：本题考查最常见口腔颌面部间隙感染之一。咬肌间隙感染（A对）为最常见口腔颌面部间隙感染之一。舌下间隙感染（B错）不多见。